饮用水要求在流行病学上安全，主要是为了确保
A. 不发生消化道疾病
B. 不发生介水传染病
C. 不发生食物中毒
D. 不发生急、慢性中毒
E. 不发生水型地方病

正确答案：B。不发生介水传染病

解析：本题考查饮用水在流行病学上安全性。饮用水要求在流行病学上安全，主要是为了确保不发生介水传染病（B对ACDE错）。介水传染病指通过饮用或接触受病原体污染的水而传播的疾病，又称水性传染病。